适用于Ⅱa、Ⅱb型及家族性杂合子的高脂蛋白血症，但有特殊臭味和一定刺激性的药物是
A. 洛伐他汀
B. 吉非贝齐
C. 考来烯胺
D. 烟酸
E. 普罗布考

正确答案：C。考来烯胺